骨碎补适用于肾虚所致的
A. 腰痛
B. 耳鸣
C. 牙痛
D. 久泻
E. 胎漏

正确答案：A、B、C、D。腰痛；耳鸣；牙痛；久泻

解析：本题考查的是骨碎补的主治病证。骨碎补适用于肾虚所致的腰痛（A对）、耳鸣（B对）、牙痛（C对）与久泻（D对）。骨碎补：【主治病证】（1）肾虚之腰痛、脚弱、耳鸣、耳聋、牙痛、久泻。（2）跌仆闪挫，筋伤骨折。菟丝子：【主治病证】（1）肾虚之腰膝酸痛、阳痿、滑精、尿频、白带过多。（2）肝肾不足之目暗不明。（3）脾虚便溏或泄泻。（4）肾虚之胎漏（E错）、胎动不安。（5）阴阳两虚之消渴。